磺胺类药抑菌机制不正确是
A. 增加二氢叶酸合成酶活性
B. 抑制细菌核酸合成
C. 磺胺药与对氨基苯甲酸具有类似结构
D. 磺胺药属酶的竞争性抑制剂
E. 药物可致四氢叶酸合成障碍

正确答案：A。增加二氢叶酸合成酶活性

解析：磺胺类药物的化学结构与对氨基苯甲酸相似，是通过与对氨基苯甲酸竞争二氢叶酸合成酶的方式来阻止FH2合成的，并非增加二氢叶酸合成酶活性。掌握“辅酶与酶促反应”知识点。